分离游离羟基蒽醌混合物的最佳方案是
A. 采用不同溶剂，按极性由弱至强顺次提取
B. 采用不同溶剂，按极性由强至弱顺次提取
C. 溶于乙醚后，依次用不同碱萃取，碱度由弱至强
D. 溶于乙醚后，依次用不同碱萃取，碱度由强至弱
E. 溶于碱水后，依次加不同酸用乙醚萃取，酸度由强至弱

正确答案：C。溶于乙醚后，依次用不同碱萃取，碱度由弱至强

解析：本题考查的是羟基蒽醌混合物的提取。分离游离羟基蒽醌混合物的最佳方案是溶于乙醚后，依次用不同碱萃取，碱度由弱至强（C对）。蒽醌类衍生物酸性强弱的排列顺序为：含-COOH＞含两个以上β-OH＞含一个β-OH＞含两个以上α-OH＞含一个α-OH。在分离工作中，常采取碱梯度萃取法来分离蒽醌类化合物。如用碱性不同的水溶液（5%碳酸氢钠溶液、5%碳酸钠溶液、1%氢氧化钠溶液、5%氢氧化钠溶液）依次提取，其结果为酸性较强的化合物（带-COOH或两个β-OH）被碳酸氢钠提出；酸性较弱的化合物（带一个β-OH）被碳酸钠提出；酸性更弱的化合物（带两个或多个α-OH）只能被1%氢氧化钠提出；酸性最弱的化合物（带一个α-OH）则只能溶于5%氢氧化钠。